下述哪种结构不属于保证心腔内血液定向流动的装置
A. 三尖瓣
B. 二尖瓣
C. 腱索
D. 肺动脉瓣
E. 静脉瓣

正确答案：E。静脉瓣

解析：三尖瓣（A对）、二尖瓣（B对）、腱索（C对）、肺动脉瓣（D对）均属于保证心腔内血液定向流动的装置。静脉瓣（E错，为本题正确答案）为保证静脉血液向心流动和防止静脉血液逆流。